某地某年简略寿命中1岁组的期望寿命为71.3岁，则0岁组的期望寿命为
A. 71岁
B. 71～71.3岁
C. ＜71.3岁
D. ＞74岁
E. 可能大于71.3岁，也有可能小于71.3岁

正确答案：E。可能大于71.3岁，也有可能小于71.3岁